某研究组调查得甲县食管癌死亡率p＝43.12/10万，乙县食管癌死亡率p＝39.46/10万，经标准化后，甲县标准化食管癌死亡率p'＝45.23/10万，乙县标准化食管癌死亡率p'＝49.87/10万。计算得到的各县标准化食管癌死亡率
A. 完全可代替实际的食管癌死亡率
B. 更能反映食管癌死亡的实际水平
C. 只能说明两县食管癌死亡相互对比的水平
D. 更能反映两县食管癌死亡率的发展变化趋势
E. 更能说明各自食管癌死亡的频率或强度

正确答案：C。只能说明两县食管癌死亡相互对比的水平